上市后开发新适应证用于强化麻醉的药物是
A. 利多卡因
B. 阿司匹林
C. 后马托品
D. 异丙嗪
E. 金刚烷胺

正确答案：D。异丙嗪